因处方组成含马来酸氯苯那敏，易引起嗜睡，故服药期间不得驾驶车、船，不得从事高空作业、机械作业及操作精密仪器的成药是
A. 藿胆丸
B. 鼻炎康片
C. 辛芩颗粒
D. 千柏鼻炎片
E. 鼻渊舒口服液

正确答案：B。鼻炎康片

解析：本题考查的是鼻炎康片的注意事项。因处方组成含马来酸氯苯那敏，易引起嗜睡，故服药期间不得驾驶车、船，不得从事高空作业、机械作业及操作精密仪器的成药是鼻炎康片（B对）。鼻炎康片：【注意事项】过敏性鼻炎属虚寒症者慎用。肺脾气虚或气滞血瘀者慎用。运动员慎用。服药期间，戒烟酒，忌辛辣食物。所含苍耳子有小毒，故不宜过量服用或持久服用。含马来酸氯苯那敏，易引起嗜睡，服药期间不得驾驶车、船，不得从事高空作业、机械作业，以及操作精密仪器等；又因其对H₁受体有阻断作用，故膀胱颈梗阻、甲状腺功能亢进、青光眼、高血压和前列腺肥大者慎用。孕妇及哺乳期妇女慎用。藿胆片（A错）：【注意事项】对本品过敏者禁用。过敏体质者慎用。不宜在服药期间同时服用滋补性中药。有高血压、心脏病、肝病、糖尿病、肾病等慢性病严重者应在医师指导下服用。儿童、孕妇、哺乳期妇女、年老体弱者、脾虚便溏者应在医师指导下服用。服药3天症状无缓解者，应去医院就诊。辛芩颗粒（C错）：【注意事项】外感风热或风寒化热者慎用。服药期间，戒烟酒，忌食辛辣之物。含有小毒的苍耳子与细辛，故不宜过量或持久服用。千柏鼻炎片（D错）：【注意事项】外感风寒、肺脾气虚者慎用。高血压、青光眼患者慎用。服药期间，忌食辛辣厚味、油腻、鱼腥发物，戒烟酒。因含千里光，故不宜过量或持久服用。有文献报道，服用本品可引起肝脏损害，偶有胸痛、口干等。鼻渊舒口服液（E错）：【注意事项】孕妇慎用。肺脾气虚或气滞血瘀者慎用。对本品过敏者忌用。服药期间，戒烟酒，忌辛辣油腻食物。所含细辛、苍耳子均有小毒，故不宜过量或持久服用。